患者，男，56岁，哮喘病史6年。哮喘急性发作时，为快速缓解症状，首选的药物是
A. 孟鲁司特钠片
B. 沙丁胺醇气雾剂
C. 氨茶碱缓释片
D. 布地奈德气雾剂
E. 异丙托溴铵气雾剂

正确答案：B。沙丁胺醇气雾剂

解析：本题考查沙丁胺醇。患者，男，56岁，哮喘病史6年。哮喘急性发作时，为快速缓解症状，首选的药物是沙丁胺醇气雾剂（B对）。短效β₂受体激动剂吸入给药，能够迅速缓解支气管痉挛，通常在数分钟内起效，疗效可维持数小时，是缓解轻至中度哮喘急性症状的首选药物。孟鲁司特钠片（A错）为白三烯受体阻断剂。氨茶碱缓释片（C错）为茶碱类药物。布地奈德气雾剂（D错）为糖皮质激素类药物，用于哮喘慢性持续期的治疗。异丙托溴铵气雾剂（E错）属于短效抗胆碱药。